呋塞米利尿的主要作用部位是
A. 远曲小管近端
B. 远曲小管远端
C. 肾小管髓袢升支粗段
D. 集合管
E. 肾小球

正确答案：C。肾小管髓袢升支粗段

解析：本题考查呋塞米利尿的作用部位。呋塞米利尿的主要作用部位是肾小管髓袢升支粗段（C对）。呋塞米为高效能利尿药，主要作用部位在髓袢升支粗段，干扰Na⁺-K⁺-2Cl⁻共同转运系统，产生强大的利尿作用。远曲小管近端（A错）是噻嗪类利尿药的主要作用部位。远曲小管远端（B错）和集合管（D错）是保钾利尿药的主要作用部位。